能够提供巯基，具有解毒、抗组胺、清除自由基和保护肝细胞作用的药物是
A. 硫普罗宁
B. 复方氨基酸
C. 双环醇
D. 异甘草酸镁
E. 腺苷蛋氨酸

正确答案：A。硫普罗宁